目前国内外对健康损失的估算通常采用
A. 人力资本法和支付意愿法
B. 计算死亡率和发病率法
C. 估算健康寿命损失年法
D. 计算超死亡数和超病例数
E. 监测人群健康效应法

正确答案：A。人力资本法和支付意愿法

解析：本题考查目前国内外对健康损失的估算通常采用的方法。目前国内外对健康损失的估算通常采用人力资本法和支付意愿法（A对BCDE错）。人力资本法是计算由于环境污染造成的死亡或疾病而产生的经济损失，包括工资损失与医疗费支出。支付意愿法测量的是人们对提高自己和其他人的安全（如环境质量改善而导致的个体死亡/发病风险降低）而愿意付出的货币数值。